右束支通过的结构是
A. 界峭
B. 室上峭
C. 室间隔膜部
D. 隔缘肉柱
E. 乳头肌

正确答案：D。隔缘肉柱

解析：隔缘肉柱（D对）为右束支通过的结构，在右心室手术时，要防止损伤隔缘肉柱，以免发生右束支传导阻滞。